肺表面活性物质减少将导致
A. 肺难于扩张
B. 肺弹性阻力减小
C. 肺顺应性增大
D. 肺泡内液体表面张力降低
E. 小肺泡内压小于大肺泡内压

正确答案：A。肺难于扩张

解析：肺表面活性物质的主要作用是：①降低肺泡表面张力，减小肺泡的回缩力；②使肺顺应性增大，肺弹性阻力减小；③维持肺泡的稳定性。因此肺表面活性物质减少将导致：①肺泡内液体表面张力增大（D错），肺泡回缩，肺萎陷，肺难于扩张（A对）；②使肺顺应性降低（C错），肺弹性阻力增大（B错）；③使小肺泡表面张力减小，大肺泡表面张力增大（E错），从而维持大小肺泡内压的稳定。